女子婚后未避孕，有正常性生活，同居2年，而未受孕者，称为
A. 绝对不孕
B. 五不女
C. 断绪
D. 不育
E. 全不产

正确答案：E。全不产

解析：凡婚后未避孕，有正常性生活，同居2年，而未受孕者，称为不孕证。从未妊娠者，古称全不产（E对），西医称之为原发性不孕。绝对不孕是指夫妇一方有先天或后天生殖器官解剖生理方面的缺陷或损伤，无法纠正而不能妊娠者（A错）。五不女指女子先天性生理缺陷统称，指螺(或骡)、纹、鼓、角、脉五种病症。前人认为这类情况没有生育的能力，故名（B错）。断续指有过妊娠而后不孕者（C错）。不育指夫妇同居未采取避孕措施两年以上，而无生育者，女方检查正常，男方检查异常，中医学称本病为“无嗣”（D错）。